下述说法正确的是
A. 3～6岁儿童应在家长监督与指导下使用每次“豌豆”大小的含氟牙膏。
B. 高氟地区，12岁以下儿童不推荐使用含氟牙膏。
C. 对于6岁以上儿童，每天使用含氟浓度高于1500mg/kg的牙膏刷牙2次，可有效防龋。
D. 儿童过多吞咽含氟牙膏，一般不会产生氟牙症的危险。
E. 成人每次含氟牙膏用量约2g。

正确答案：A。3～6岁儿童应在家长监督与指导下使用每次“豌豆”大小的含氟牙膏。

解析：本题考查含氟牙膏的使用和防龋效果。下述说法正确的是3～6岁儿童应在家长监督与指导下使用每次“豌豆”大小的含氟牙膏（A对）。1.出生后一直在高氟区居住，可使全口牙受侵害；如2岁前生活在高氟区，以后迁移至非高氟区，恒牙氟牙症可仅累及前牙和第一恒磨牙；如果6～7岁以后再迁入高氟区，则不会出现氟牙症。因此，高氟地区，6岁以下儿童不推荐使用含氟牙膏（B错）。2.对于6岁以上的儿童和成人，每天用含氟浓度高于1000mg/kg的牙膏刷牙两次（C错），每次用量约1g（E错）（约1cm长度的牙膏量），可达到有效的预防效果。3～6岁的儿童，每次牙膏用量约为‘豌豆’大小，同时，应在家长监督与指导下使用。3.儿童过多吞咽含氟牙膏，一般会产生氟牙症的危险（D错）。